引起早产最常见的原因
A. 子宫畸形
B. 急性肾盂肾炎
C. 胎盘早剥
D. 下生殖道及泌尿道感染
E. 吸烟，酗酒

正确答案：D。下生殖道及泌尿道感染

解析：诱发早产的常见因素有：①宫内感染，30%～40%的早产与此有关；②下生殖道及泌尿道感染（D对），如急性肾盂肾炎（B错）等；③妊娠合并症与并发症；④子宫膨胀过度或子宫畸形（A错）；⑤胎盘因素，如前置胎盘、胎盘早剥（C错）等；⑥宫颈内口松弛。吸烟、酗酒（E错）也会增加早产的发生率。